下列哪项不属利福平的不良反应
A. 过敏反应
B. 胃肠道反应
C. 肝损害
D. 周围神经炎
E. 流感综合征

正确答案：D。周围神经炎

解析：本题考查利福平的不良反应。周围神经炎（D错，为本题正确答案）不属利福平的不良反应。周围神经炎为异烟肼的常见不良反应。利福平的不良反应包括：过敏反应（A对）、胃肠道反应（B对）、肝损害（C对）、流感综合征（E对）、尿液等体液呈橘红色或红棕色。